患者，女，32岁，已婚未孕。3个月前出现腹泻，多为稀糊状，间断为黏液及脓血便，每日8～12次，有里急后重感，结肠镜检査诊断溃疡性结肠炎（全结肠型），医师处方美沙拉嗪缓释片和美沙拉嗪灌肠剂。关于该患者用药注意事项的说法，正确的是
A. 美沙拉嗪缓释片不可随餐服用，必须空腹服用
B. 用药期间需常规补充叶酸
C. 美沙拉嗪缓释片可掰开后服用，但不能咀嚼
D. 美沙拉嗪灌肠剂应清晨给药
E. 无需监测肾功能，但需监测血常规

正确答案：C。美沙拉嗪缓释片可掰开后服用，但不能咀嚼

解析：本题考查美沙拉嗪。美沙拉嗪缓释片可掰开后服用，但不能咀嚼（C对）。口服5-ASA的缓、控释制剂均不能咀嚼，以免破坏药物制剂的结构。肠溶片应于餐前1小时整片吞服；缓释片由多个微颗粒组成，可掰开后服用或与水（橘汁）混合为混悬液后饮用，可随餐服用（A错）。灌肠剂于睡前（D错）经灌药器将药液挤入直肠内。服用该类药物期间注意监测全血细胞计数和尿液检查。一般情况下，在治疗开始2周后进行检查。此后，每用药4周进行相应检查；2～3次检查结果未见异常后，每3个月应进行1次血清尿素氮、血肌酐和尿沉渣等反映肾功能的检查（E错）。